下列关于乙型肝炎病毒“大三阳”的表述，正确的是
A. 提示乙型肝炎病毒在人体内复制活跃
B. 具有传染性，需要实行隔离治疗
C. 如果肝功正常，定期监测，不需要抗病毒治疗
D. 造成肝脏炎症，即使肝酶正常，也需要抗病毒治疗
E. 提示患者为乙型肝炎病毒无症状携带者

正确答案：A、B、D。提示乙型肝炎病毒在人体内复制活跃；具有传染性，需要实行隔离治疗；造成肝脏炎症，即使肝酶正常，也需要抗病毒治疗

解析：本题考查大三阳。“大三阳”说明HBV在人体内复制活跃（A对），带有传染性；如同时见AST及ALT升高，为最具有传染性的一类肝炎，应尽快隔离（B对）。造成肝脏炎症，即使肝酶正常，也需要抗病毒治疗（D对）。“小三阳”说明HBV在人体内复制减少，传染性小；如肝功能正常，又无症状，称为乙型肝炎病毒无症状携带者（E错），不需要隔离。